16个月婴儿，在7个多月只喂玉米粉，最后3个月体重不增。间断腹泻10余天才来就诊。入院时全身皮肤干燥，两眼都出现结膜干燥斑，角膜正常。预防此类疾病的发生，在膳食中可补充的食物是
A. 海产品
B. 米粉
C. 橙黄色蔬菜与肝
D. 瘦肉
E. 动物脂肪

正确答案：C。橙黄色蔬菜与肝

解析：本题考查维生素A缺乏症的预防措施。该名患儿7个多月只喂玉米粉，维生素A及胡萝卜素摄入量明显不足。有慢性腹泻病史，且皮肤结膜症状明显。维生素A缺乏时，可引起毛囊角化等皮肤黏膜改变，以及角膜软化、夜盲等眼部症状。首先因免疫功能低下而易患各种感染，临床表现可有皮肤、结膜、角膜干燥，严重者角膜软化。预防措施：1.提倡母乳喂养，母乳中的维生素A含量较其他乳类高，人工喂养的婴儿应尽量选择强化维生素A的配方奶；2.增加富含维生素A辅食的摄入量：富含维生素A的食物包括动物性食物，尤其是肝脏；橙黄色（C对ABDE错）和深绿色蔬菜及水果，如胡萝卜、南瓜等；3.补充维生素A制剂：在维生素A缺乏的高发地区，推荐预防性补充维生素A；4.积极治疗急慢性感染、肝胆疾病和慢性消耗性疾病，并及早补充维生素A制剂。